男，4岁，右侧阴囊肿大，软，透光实验阳性，平卧后可消失。最可能的诊断是
A. 附睾囊肿
B. 附睾结核
C. 交通性鞘膜积液
D. 睾丸鞘膜积液
E. 睾丸肿瘤

正确答案：C。交通性鞘膜积液

解析：该患者男，4岁，出现右侧阴囊肿大，软，平卧后可消失，透光实验阳性，结合患者的表现和辅助检查，诊断为交通性鞘膜积液，交通性鞘膜积液是因为发育等原因，鞘状突未完全闭合，鞘膜囊通过鞘状突与腹腔相互交通，腹腔内液体因体位、腹腔压力等原因进入鞘膜囊形成。所以白天渐渐出现，躺下消失（C对）。